患者泄泻腹痛，泻下急迫，粪色黄褐而臭，肛门灼热，烦热口渴，小便短少，舌苔黄腻，脉滑数。其治法是
A. 消食导滞
B. 泄热导滞
C. 清热利湿
D. 通腑泄热
E. 通腑消食

正确答案：C。清热利湿

解析：题中患者以泄泻腹痛，泻下急迫，粪色黄褐而臭为主症，无里急后重感，无赤白脓血，故诊断为泄泻。泄泻腹痛为感受湿热之邪，肠腑传化失常所致，肠中有热，热邪类火，火性急迫，故泻下急迫；湿热下注故粪色黄褐而臭，肛门灼热，小便短少；烦热口渴，舌苔黄腻，脉滑数为湿热内盛之象，故辨为泄泻湿热证，治宜清热利湿（C对），选方：葛根芩连汤加减。消食导滞为泄泻食滞肠胃证的治法（A错）。泄热导滞为热结便秘的治法（B错）。通腑泄热为胃肠积热的治法（D错）。通腑消食为食滞胃肠的治法（E错）。